一种化学物质能减弱另一种化学物质的毒性称为
A. 相加作用
B. 协同作用
C. 独立作用
D. 拮抗作用
E. 综合作用

正确答案：D。拮抗作用

解析：本题考查拮抗作用。一种化学物质能减弱另一种化学物质的毒性称为拮抗作用（D对ABCE错）。